冠缘放在龈下时，冠缘距龈沟底应至少为
A. 1mm
B. 1.5mm
C. 1.8mm
D. 2mm
E. 2.5mm

正确答案：A。1mm

解析：当必须将冠缘放在龈下时，不应超过龈沟深度的1/2（健康的龈沟一般为2mm），冠缘距龈沟底至少1mm，不得延伸至沟底，且必须与牙面高度密合。掌握“牙周健康与修复”知识点。